男，2岁，因先天性腭裂行腭成形术，术后2天，家长述患儿睡眠打鼾，轻度呼吸困难，主要原因是
A. 术后局部组织肿胀所致
B. 术后软腭组织被延长所致
C. 术后软腭内血肿所致
D. 术后腭咽径缩小所致
E. 术后软腭运动增强所致

正确答案：A。术后局部组织肿胀所致

解析：本题考查腭裂手术治疗的术后并发症。男，2岁，因先天性腭裂行腭成形术，术后2天，家长述患儿睡眠打鼾，轻度呼吸困难，主要原因是术后局部组织肿胀所致（A对）。术后局部组织肿胀可引起打鼾及睡眠时暂时性呼吸困难；腭裂手术后软腭血肿可能会引起窒息（C错）；腭咽成形术的目的是延长软腭长度、增加软腭动度、使腭咽径缩小（BDE错）。